中成药因剂型不同采用的贮存养护方法也不同。除另有规定外，应置遮光容器内密封和阴凉处贮存的中成药剂型是
A. 涂膜剂
B. 气雾剂
C. 贴膏剂
D. 凝胶剂
E. 流浸膏剂

正确答案：E。流浸膏剂

解析：本题考查的是中成药剂型与贮藏要求。除另有规定外，应置遮光容器内密封和阴凉处贮存的中成药剂型是流浸膏剂（E对）。中成药有多种剂型，成分、性质也很复杂，所以要针对不同剂型采取不同的保管养护办法，以确保药品质量。1.丸剂：丸剂可分为蜜丸、水丸、糊丸、浓缩丸、蜡丸等。（1）蜜丸：一般应密封后，贮存于干燥处，应防潮、防霉变、防虫蛀。应防止重压与受热。（2）水丸、糊丸：宜密封置于干燥处。（3）浓缩丸：可同水丸、糊丸一样保管养护，密封贮存。（4）蜡丸：应密封并置阴凉干燥处贮存。除另有规定外，各种丸剂均应密封贮存。2.散剂：除另有规定外，散剂应密封贮存，含挥发性药物或易吸潮药物的散剂应密封贮存。3.片剂：除另有规定外，片剂应密封贮存。4.膏剂：膏剂分为内服和外用两类。内服的膏剂多叫煎膏剂（俗称膏滋）；外用的膏剂分为药膏（软膏剂）和膏药两种。（1）煎膏剂（膏滋）：除另有规定外，煎膏剂应密封，置阴凉处贮存。（2）膏药：除另有规定外，膏药应密闭，置阴凉处贮存。（3）软膏剂（油膏）：除另有规定外，软膏剂应避光，密封贮存。5.合剂：除另有规定外，合剂应密封，置阴凉处贮存。6.颗粒剂：除另有规定外，颗粒剂应密封，在干燥处贮存，防止受潮。7.胶囊剂：除另有规定外，胶囊剂应密封贮存。8.糖浆剂：除另有规定外，糖浆剂应密封，置阴凉处贮存。9.注射剂：除另有规定外，注射剂应遮光贮存。10.胶剂：应密闭，置于室内阴凉干燥处贮存，防止受潮。11.酒剂：除另有规定外，酒剂应密封，置阴凉处贮存。12.露剂：除另有规定外，露剂应密封，置阴凉处贮存。13.栓剂：除另有规定外，应在30℃以下密闭贮存，防止因受热、受潮而变形、发霉、变质。14.其他剂型：（1）锭剂：除另有规定外，应密闭，置阴凉干燥处贮存。（2）贴膏剂（C错）：除另有规定外，应密封贮存。（3）滴丸剂：除另有规定外，应密封贮存。（4）酊剂：除另有规定外，应置遮光容器内密封，置阴凉处贮存。（5）流浸膏剂与浸膏剂：除另有规定外，应置遮光容器内密封，流浸膏剂应置阴凉处贮存。（6）凝胶剂（D错）：除另有规定外，应避光，密闭贮存，并应防冻。（7）茶剂：应密闭贮存；含挥发性及易吸潮药物的茶剂应密封贮存。（8）搽剂、洗剂、涂膜剂（A错）：除另有规定外，均应密封贮存。（9）鼻用制剂：除另有规定外，应密闭贮存。（10）眼用制剂：除另有规定外，应遮光密封，置阴凉处贮存。（11）气雾剂（B错）、喷雾剂：除另有规定外，均应置凉暗处贮存，并避免曝晒、受热、撞击。